能够影响生物膜通透性的制剂辅料是
A. 表面活性剂
B. 络合剂
C. 崩解剂
D. 稀释剂
E. 黏合剂

正确答案：A。表面活性剂

解析：本题考查表面活性剂。表面活性剂系（A对）指具有很强的表面活性、加入少量就能使液体的表面张力显著下降的物质，它可以影响生物膜的通透性；络合剂（B错）是指能与金属离子形成络合离子的化合物；崩解剂（C错）指促使片剂在胃肠液中迅速破裂成细小颗粒的辅料；稀释剂（D错）也叫“填充剂”，是把原料加工成粉剂时,或为了使其便于喷施所加入的进行稀释的惰性物质；黏合剂（E错）是给予物料黏性的辅料。